下列哪些药物用高氯酸进行非水溶液滴定时需要加入醋酸汞试液
A. 氢溴酸东莨菪碱
B. 奋乃静
C. 尼可刹米
D. 氯氮䓬
E. 盐酸吗啡

正确答案：A、E。氢溴酸东莨菪碱；盐酸吗啡

解析：本题考查非水溶液滴定法。氢溴酸东莨菪碱（A对）、盐酸吗啡（E对）用高氯酸进行非水溶液滴定时需要加入醋酸汞试液。氢卤酸的酸性较强，因此有机碱的氢卤酸盐在滴定反应时往往反应不完全，需要在先加入醋酸汞试液与卤素反应生成卤化汞，卤化汞难电离，可消除氢卤酸的干扰。奋乃静（B错）与尼可刹米（C错）用高氯酸进行滴定时无需加入醋酸汞。氯氮䓬（D错）用分光光度法测定含量。